在下列各项中，医师可以行使特殊的干涉权的是
A. 对需要隔离的传染病患者拒绝隔离的
B. 在教学医院内住院的患者拒绝接受医学生实习
C. 在有科研任务的医院内住院的患者拒绝作为受试者
D. 门诊就医的患者拒绝按医师开出的特殊检查项目进行检查
E. 门诊就医的患者拒绝向医师吐露与疾病有关的隐私

正确答案：A。对需要隔离的传染病患者拒绝隔离的

解析：特殊干涉权，是指医生在特殊情况下，有权限制病人的自主权利，以确保病人自身、他人和社会的安全。医生不是任意的行使特殊干涉权，只有在下列特殊情况下行使才有效：①精神病患者或自杀未遂等拒绝治疗时，甚至病人想要或正在自杀时；②对需要进行隔离治疗的传染病病人的隔离（A对）；③在进行试验性治疗时，虽然病人已知情同意，一旦出现高度危险情况时，医生必须中止试验性治疗，以保护病人的利益；④危重病人要求了解自己疾病的真相，一旦了解可能产生不良影响，医生有权隐瞒真相。当在教学医院内住院的患者拒绝接受医学生实习（B错）、在有科研任务的医院内住院的患者拒绝作为受试者（C错）、门诊就医的患者拒绝按医师开出的特殊检查项目进行检查（D错）、门诊就医的患者拒绝向医师吐露与疾病有关的隐私（E错）时，医师不得行使干涉权。